下列痤疮治疗药物中，应用前须排除妊娠的有
A. 过氧苯甲酰
B. 维A酸
C. 壬二酸
D. 异维A酸
E. 阿达帕林

正确答案：B、D、E。维A酸；异维A酸；阿达帕林

解析：本题考查妊娠用药。维A酸（B对）、异维A酸（D对）、阿达帕林（E对）均为抗角化药。抗角化药禁用于药物过敏者、妊娠及哺乳期妇女禁用。过氧苯甲酰（A错）可以小面积谨慎使用（妊娠分级C）。外用壬二酸（C错）是安全的（妊娠分级B）。